不属于住宅设计中的主要卫生防护措施的是
A. 保温与隔热
B. 遮阳与采暖
C. 通风换气
D. 经常性卫生监督
E. 噪声控制

正确答案：D。经常性卫生监督

解析：本题考查住宅设计中的主要卫生防护措施。住宅设计中的主要卫生防护措施包括：1.保温与隔热（A对）：建筑材料的导热性越低，建筑物的保温与隔热性能越好，越有利于住宅的防寒和防暑。因此，应尽可能选择导热系数较小的建筑材料。2.遮阳与采暖（B对）：遮阳能避免室内过热，避免产生眩光，也可防止雨水侵入室内；采暖方式和设备主要分两类：①分散式采暖，常用的设备有火炉、炕、火墙。这类采暖应特别注意排气通畅。②集中式采暖，这类采暖便于集中管理、热效率高、较易调节、室内空气不致污染、占地面积小、可布置在适当地点室内气温较均匀。3.通风换气（C对）：居室必须有适当的通风换气以改善室内小气候、降低室内空气中二氧化碳和有害气体的浓度，减少病原微生物和灰尘的数量，以及促进氡等有害物质的排出。4.噪声控制（E对）：根本性措施在于居住区要与工业区、商业区、交通干线、机场、火车站隔离。采取有效的立法、技术和管理措施是治理噪声污染的关键。经常性卫生监督（D错，为本题正确答案）是住宅的卫生监督内容。